不引起剥脱性龈病损的疾病是
A. 白斑
B. 天疱疮
C. 扁平苔藓
D. 类天疱疮
E. 红斑狼疮

正确答案：A。白斑

解析：本题考查引起剥脱性龈病损的疾病。白斑（A错，为本题的正确答案）指口腔黏膜上的白色斑块或斑片，不能擦去，也不能诊断为其他疾病。剥脱性龈病损是局限于牙龈的发红及脱屑样病变，主要表现为牙龈鲜红、光亮及上皮表层剥脱，呈现牙龈表面粗糙并红亮。剥脱性龈病损其镜下可分为疱型与苔藓型。疱型为上皮与结缔组织间形成基底下疱，病变同类天疱疮（D对），如在上皮层内形成上皮内疱，则病变同天疱疮（B对）。苔藓型者，上皮萎缩、棘层变薄，基底细胞水肿、液化，固有层可见密集的淋巴细胞浸润，病变多符合于类天疱疮样扁平苔藓或萎缩型扁平苔藓（C对）。红斑狼疮（E对）累及牙龈表现为龈黏膜凹下，病损四周有放射状细短白纹，即也有龈病损表现。